肿疡已成，毒盛正气不虚，尚未溃破或溃而脓出不畅者，治疗应首选
A. 透托法
B. 温通法
C. 清热法
D. 消法
E. 补托法

正确答案：A。透托法

解析：透托法用于疮疡酿脓尚未成熟，毒气虽盛而正气未衰者（A对）。温通法（B错）为治疗虚寒阴证的代表治法。清热法（C错）用于热毒之证。消法（D错）适用于尚未成脓的初期肿疡。补托法（E错）适用于正虚毒盛，不能托毒外达之虚证。